长期应用能抑制胰高血糖素分泌的药物是
A. 吡格列酮
B. 格列本脲
C. 二甲双胍
D. 阿卡波糖
E. 罗格列酮

正确答案：B。格列本脲

解析：本题考查格列本脲。格列本脲（B对）能够促进胰岛素的释放，降低血清糖原水平，长期使用能够抑制胰高血糖素的释放。二甲双胍（C错）为双胍类降血糖药，作用机制是通过减少肠道内葡萄糖的吸收以及糖原异生，抑制胰高血糖素的释放。阿卡波糖（D错）为葡萄糖苷酶抑制剂。吡格列酮（A错）、罗格列酮（E错）均为噻唑烷二酮类胰岛素增敏剂。